牙本质龋的病理改变由病损表层向深部依次为
A. 透明层、细菌侵入层、脱矿层、坏死崩解层
B. 透明层、脱矿层、细菌侵入层、坏死崩解层
C. 细菌侵入层、脱矿层、透明层、坏死崩解层
D. 坏死崩解层、脱矿层、细菌侵入层、透明层
E. 坏死崩解层、细菌侵入层、脱矿层、透明层

正确答案：E。坏死崩解层、细菌侵入层、脱矿层、透明层

解析：本题考查牙本质，牙骨质龋。一般可将牙本质龋的病理改变由病损深部向表面分为四层结构：①透明层；②脱矿层；③细菌侵入层；④坏死崩解层。题干要求选择的是由病损表层向深部的顺序（E对）。